下列关于牙齿附着于颌骨的方式，下列说法错误的是
A. 端生牙为牙齿附着于颌骨的方式之一
B. 槽生牙为牙齿附着于颌骨的方式之一
C. 侧生牙为牙齿附着于颌骨的方式之一
D. 侧生牙较端生牙牢固
E. 端生牙不易脱落

正确答案：E。端生牙不易脱落

解析：牙附着于颌骨的方式分为端生牙、侧生牙、槽生牙，其中端生牙附着于颌骨的边缘，易脱落，侧生牙虽无完善的牙根，但比端生牙牢固。掌握“牙的演化”知识点。